患者，男，42岁。4年来经常腹胀，下肢浮肿。查体：前胸有蜘蛛痣，腹水，肝未触及，脾大。应首先考虑的是
A. 普通型病毒性肝炎
B. 门脉性肝硬化
C. 酒精性肝炎
D. 肝细胞肝癌
E. 慢性肝淤血

正确答案：B。门脉性肝硬化

解析：患者前胸有蜘蛛痣，有腹水，肝未触及，脾大，应首先考虑的是门脉性肝硬化（B对）。门静脉高压肝硬化病理表现有：①门体侧支循环开放，食管胃底静脉曲张、痔核、腹壁静脉扩张。②脾大及脾功能亢进，红细胞、白细胞、血小板减少，有出血倾向及贫血。③腹水，腹胀，移动性浊音阳性。普通型病毒性肝炎（A错）、酒精性肝炎（C错）可为门静脉性肝硬化的前期诱因及表现。肝细胞肝癌（D错）除了有肝硬化的征象外，还表现为肝区疼痛，肝大，黄疸，消瘦，发热，乏力，营养不良，恶病质及其他并发症。慢性肝淤血（E错）表现可有肝脏肿大。